某女，21岁，未婚，否认性生活史，体检填写病史时主诉自觉下腹胀痛，妇科检查时应采取的检查方法为
A. 双合诊
B. 三合诊
C. 肛诊
D. 腹部触诊
E. 都不对

正确答案：C。肛诊

解析：本题考查未婚妇女的妇科检查方法。了解未婚妇女妇科情况应行肛诊（C对ABDE错），检查子宫位置、大小、形状、质地、活动度及有无肿物，检查双附件有无增厚、压痛及肿物。